涎石病第二好发部位
A. 腮腺
B. 唇腺
C. 腭腺
D. 舌下腺
E. 下颌下腺

正确答案：A。腮腺

解析：涎石病是在腺体或导管内发生钙化性团块而引起的一系列病变。85%左右发生于下颌下腺，其次是腮腺，偶见于上唇及唇颊部的小唾液腺，舌下腺很少见。涎石常使唾液排出受阻，并继发感染，造成腺体急性或反复发作的炎症。掌握“涎石病及下颌下腺炎”知识点。